患者，男，60岁。腹胀大如鼓，按之如囊裹水，有波动感应首先考虑的是
A. 水饮
B. 痞满
C. 积聚
D. 水臌
E. 内痈

正确答案：D。水臌

解析：水饮根据停积的部位不同，分为痰饮、悬饮、支饮、溢饮，均不会导致腹胀大如鼓（A错）。痞满是指胸腹痞闷胀满不舒，外无胀大之形（B错）。积聚有胀满、疼痛、包块的临床表现，但腹中无水液停聚（C错）。腹胀大如鼓，按之如囊裹水，有波动感，为水湿停于腹中，为水鼓（D对）。内痈系脏腑之生痈疽者，内痈之肠痈于水鼓相似，但水鼓无腹部的疼痛（E错）。